典型的矽肺最重要和最常见的X线表现
A. 肺纹理增多，增粗
B. 肺的阴影增大
C. 密度较高的圆形和类圆形的阴影
D. 胸膜粘连和肥厚
E. 弥漫性肺气肿

正确答案：C。密度较高的圆形和类圆形的阴影

解析：矽肺（硅肺）是长期吸入含游离二氧化硅（SiO₂）粉尘沉着于肺组织所引起的一种职业病，其基本病变是硅结节的形成和肺组织的弥漫性纤维化，其中硅结节最常见且最具特征性，在X线下显示为密度较高的圆形或类圆形的阴影（C对）。肺纹理增多、增粗（A错）和肺的阴影增大（B错）均可见于硅肺，但不具有特征性。胸膜肥厚胸膜粘连（D错）和弥漫性肺气肿（E错）均可并发于硅肺，但不是X线特征。